不宜单独用于治疗嗜铬细胞瘤的药物是
A. 哌唑嗪
B. 阿替洛尔
C. 酚妥拉明
D. 硝普钠
E. 酚苄明

正确答案：B。阿替洛尔

解析：阿替洛尔（B错，为本题正确答案）是β受体拮抗药，在使用之前，必须先用α受体拮抗药使血压下降，如单独使用，则由于阻断β体介导的舒血管效应而使血压升高，甚而发生肺水肿，尤其是分泌肾上腺素为主的病人。哌唑嗪（A对）为选择性的α受体拮抗药，也可获满意效果，并可避免全部α受体拮抗药的不良后果，如明显的低血压和心动过速。酚妥拉明（C对）适用于嗜铬细胞瘤所致的高血压危象。硝普钠（D对）适用于嗜铬细胞瘤麻醉诱导时出现的血压骤升。酚苄明（E对）是α受体拮抗药，适用于嗜铬细胞瘤的术前准备。